认知功能不包括
A. 方向识别能力
B. 情绪反应
C. 时间地点定位
D. 机智思维
E. 注意力和记忆力

正确答案：B。情绪反应

解析：本题考查认知功能的内容。认知功能包括方向识别能力（A对）、时间地点定位（C对）、机智思维（D对）、注意力和记忆力（E对）以及解决问题的能力等。认知功能不包括情绪反应（B错，为本题正确答案）。